病变肺部叩诊浊音，语颤增强，闻及支气管呼吸音，常见于
A. 支原体肺炎
B. 肺炎链球菌肺炎
C. 慢性支气管炎急性发作期
D. 支气管哮喘
E. 支气管扩张症

正确答案：B。肺炎链球菌肺炎

解析：肺炎链球菌肺炎（B对）常表现为大叶性肺炎，当肺实变时，可出现肺部叩诊浊音，触觉语颤增强，并可闻及支气管呼吸音。支原体肺炎（P49）（A错）属于间质性肺炎，不累及肺实质，因此体检常无阳性发现。慢性支气管炎急性发作期（C错）可于背部或双肺底闻及干湿啰音，但其肺部未有叩诊浊音、语颤增强及支气管呼吸音等体征。支气管哮喘（P29）（D错）主要表现为反复发作性呼气性呼吸困难，可自行缓解，发作时可有双肺广泛哮鸣音，但其肺部未有叩诊浊音、语颤增强及支气管呼吸音等体征。支气管扩张症（P37）（E错）可闻及背部固定持久的局限性粗湿啰音，但其肺部未有叩诊浊音、语颤增强及支气管呼吸音等体征。